生命质量评价的内容一般不包括
A. 情绪反映
B. 自身健康判断
C. 主观满意度
D. 个人生理状态
E. 个人所在家庭规模的大小

正确答案：E。个人所在家庭规模的大小